男性，25岁，双下肢挤压伤，神志尚清楚，表情淡漠，口渴明显，面色苍白，皮肤湿冷，脉搏112次/分，血压12/9.33kPa（90/70mmHg），中心静脉压0.39kPa（4cmH2O）。毛细血管充盈迟缓。血pH值为7.32。患者循环系统的病理生理改变是
A. 中毒症状
B. 心功能不全
C. 血容量相对过多
D. 血容量严重不足
E. 容量血管过度收缩

正确答案：D。血容量严重不足

解析：患者双下肢挤压伤导致中度休克，可知其循环系统的生理改变使血容量严重不足。掌握“休克”知识点。